把最好的证据用于患者群体和人群，制定保健策略和措施属于
A. 系统综述
B. meta分析
C. 循证医学
D. 循证医疗卫生决策
E. 临床实践指南

正确答案：D。循证医疗卫生决策

解析：本题考查循证医疗卫生决策的相关内容。循证医疗卫生决策（D对ABCE错）强调对个人、群体的任何保健策略和措施的制定不仅要考虑资源和价值，还要以当前科学研究的最佳成果为依据。